（牙合）支托凹底面与牙长轴的角度小于
A. 30°
B. 60°
C. 90°
D. 100°
E. 120°

正确答案：C。90°

解析：（牙合）支托凹底面与牙长轴的角度小于90°。掌握“局部义齿修复前的准备及牙体预备”知识点。